某肝癌患者病情已到晚期，处于极度痛苦之中，自认为是肝硬化，寄希望于治疗。病情进展和疼痛发作时，多次要求医生给以明确说法和治疗措施。此时，医生最佳的伦理选择应该是
A. 正确对待保密与讲真话的关系，经家属同意后告知实情，重点减轻病痛
B. 恪守保密原则，继续隐瞒病情，直至患者病死
C. 遵循病人自主原则，全面满足病人要求
D. 依据知情同意原则，应该告知病人所有信息
E. 依据有利原则，劝导病人试用一些民间土方

正确答案：A。正确对待保密与讲真话的关系，经家属同意后告知实情，重点减轻病痛

解析：对于病人的病情，伦理的选择应该适当保守秘密，前提是经过家属或者监护人同意。掌握“医患关系伦理”知识点。